影响气道阻力最重要因素是
A. 气流形式
B. 气流速度
C. 呼吸道长度
D. 呼吸道口径
E. 呼吸时相

正确答案：D。呼吸道口径